青年男性，自高处跌下，致骨盆骨折，发生排尿困难，尿潴留，会阴部肿胀，导尿管不能插入膀胱。损伤的部位应是
A. 膀胱
B. 肛门直肠
C. 后尿道
D. 尿道球部
E. 阴茎部尿道

正确答案：C。后尿道

解析：青年男性患者，骨盆骨折后发生排尿困难、尿潴留、会阴部肿胀，考虑可能有后尿道损伤，导尿管不能插入膀胱（提示有尿道断裂），结合患者病史、临床表现和相关检查，该患者最可能的诊断为后尿道损伤，即损伤的部位应是后尿道（C对）。膀胱（A错）损伤时也可出现排尿困难，但导尿管可插入膀胱。肛门直肠（P327）（B错）损伤一般不会出现排尿困难。尿道球部（D错）损伤多见于骑跨伤。阴茎部尿道（E错）损伤较少见。